粉末显微特征中有镶嵌状细胞的药材是
A. 吴茱萸
B. 砂仁
C. 小茴香
D. 五味子
E. 补骨脂

正确答案：C。小茴香

解析：本题考查的是小茴香的显微鉴别。粉末显微特征中有镶嵌状细胞的药材是小茴香（C对）。小茴香【显微鉴别】粉末：绿黄色或黄棕色。①网纹细胞壁厚，木化，具卵圆形网状壁孔。②油管显黄棕色至深红棕色，常已破碎。分泌细胞呈扁平多角形。③镶嵌状细胞为内果皮细胞，5～8个狭长细胞为1组；以其长轴相互作不规则方向嵌列。④内胚乳细胞多角形，无色，壁颇厚，含多数直径约10㎛的糊粉粒，每一糊粉粒中含细小簇晶1个，直径约7㎛。吴茱萸（A错）【显微鉴别】粉末：褐色。①非腺毛2～6细胞，长140～350㎛，壁疣明显，有的胞腔内含棕黄色至棕红色物。②腺毛头部7～14细胞，椭圆形，常含黄棕色内含物；柄2～5细胞。③草酸钙簇晶较多，直径10～25㎛；偶有方晶。砂仁（B错）【显微鉴别】粉末：灰棕色。①种皮表皮细胞淡黄色，表面观长条形，常与下皮细胞上下层垂直排列；下皮细胞含棕色或红棕色物。②油细胞无色，壁薄，偶见油滴。③内种皮厚壁细胞红棕色或黄棕色，表面观多角形，壁厚，非木化，胞腔内含硅质块。五味子（D错）【显微鉴别】粉末：暗紫色。①果皮的表皮细胞呈多角形，排列紧密整齐，表面有微细的角质线纹，内含颗粒状色素物质，随处可见类圆形或多角形的油细胞，其四周有6～7个细胞围绕。②种皮外层石细胞群呈多角形或稍长，大小颇均匀，直径18～50㎛，壁厚，孔沟极细密，胞腔小，内含棕色物质；内层石细胞呈类圆形、多角形或不规则形，直径约至83㎛，壁稍厚，纹孔较大。③种皮油细胞类圆形，含黄色挥发油。补骨脂（E错）【显微鉴别】粉末与解离组织：①种皮栅状细胞众多，长33～56㎛，宽6～15㎛，细胞壁成V字形增厚。②支持细胞哑铃状，长20～45㎛，中部细胞壁增厚。另有子叶细胞与非腺毛碎片。